五输穴主病特点中，荥主
A. 心下满
B. 身热
C. 体重节痛
D. 喘咳寒热
E. 逆气而泄

正确答案：B。身热

解析：按五输穴主病特点：荥主身热（B对）。井主心下满（A错），输主体重节痛（C错），经主喘咳寒热（D错），合主逆气而泄（E错）。